膻中又称作
A. 水谷之海
B. 经脉之海
C. 气海
D. 血海
E. 髓海

正确答案：C。气海

解析：宗气是积于胸中之气。《灵枢·海论》说：“膻中者，为气之海。”宗气在胸中积聚之处，所以“膻中”又称为“气海”（C对）。水谷之海指的是“胃”（A错）；经脉之海指的是冲脉（B错）；血海指肝脏（D错）；髓海指脑（E错）。